盐酸麻黄碱有较强的兴奋中枢神经作用，大剂量使用可引起失眠、头痛、心悸、心动过速等不良反应故高血压、动脉硬化、心绞痛患者应禁用。含盐酸麻黄碱成分的中成药有
A. 安嗽糖浆
B. 舒肺糖浆
C. 川贝枇杷糖浆
D. 苏菲咳糖浆
E. 镇咳宁糖浆

正确答案：A、B、D、E。安嗽糖浆；舒肺糖浆；苏菲咳糖浆；镇咳宁糖浆

解析：本题考查的是含西药组分的中成药。盐酸麻黄碱有较强的兴奋中枢神经作用，大剂量使用可引起失眠、头痛、心悸、心动过速等不良反应故高血压、动脉硬化、心绞痛患者应禁用。含盐酸麻黄碱成分的中成药有安嗽糖浆（A对）、舒肺糖浆（B对）、苏菲咳糖浆（D对）与镇咳宁糖浆（E对）。安嗽糖浆：功能润肺化痰，止咳平喘。用于痰热阻肺、喘息气短、咳嗽痰黏、口渴咽干。含西药成分：盐酸麻黄碱、氯化铵。舒肺糖浆：功能祛痰镇咳，用于急慢性支气管炎。含西药成分：盐酸麻黄碱、氯化铵。苏菲咳糖浆：功能祛痰镇咳。用于咳嗽、哮喘、多痰、支气管炎等。含西药成分：盐酸麻黄碱、氯化铵。镇咳宁糖浆：功能止咳，平喘，祛痰。用于风寒束肺所致的咳嗽、气喘、咳痰；支气管炎、支气管哮喘见上述证候者。含西药成分：盐酸麻黄碱。川贝枇杷糖浆（C错）不含西药成分。